“传导之官”指的是
A. 三焦
B. 胃
C. 小肠
D. 脾
E. 大肠

正确答案：E。大肠

解析：大肠具有传导糟粕的生理功能，《素问·灵兰秘典论》说“大肠者，传导之官，变化出焉”（E对）。大肠主传导是指大肠接受由小肠下移的食物残渣，吸收水分，形成糟粕，经肛门排泄粪便的功能。三焦有“孤府”、“决渎之官”之称（A错）；胃有“太仓”“水谷之海”之称（B错）；小肠有“受盛之官”之称（C错）；脾有“仓廪之官”之称（D错）。